腭扁桃体
A. 位于扁桃体上窝内
B. 在舌根部的黏膜内
C. 在鼻咽部的外侧壁内
D. 青春期发育快
E. 位于腭舌弓与腭咽弓之间

正确答案：E。位于腭舌弓与腭咽弓之间

解析：腭扁桃体位于口咽部侧壁(BC错)的扁桃体窝内(A错)，扁桃体上窝为扁桃体窝上部无腭扁桃体的部分，腭扁桃体6岁前发育快，青春期后开始萎缩(D错)，腭扁桃体位于腭舌弓与腭咽弓之间(E对)。